男，28岁，突发一侧腰痛伴尿频、尿痛，体温39.5℃，血压20/13.3kPa（150/100mmHg），尿常规：蛋白（+）、红细胞5/HP、白细胞计数3.5×105/h，尿培养大肠杆菌阳性，其可能的疾病是
A. 肾结核
B. 急性肾盂肾炎
C. 急性肾小球肾炎
D. 肾结石
E. 急性肾炎

正确答案：B。急性肾盂肾炎

解析：尿液细菌学检查对急性肾盂肾炎诊断帮助较大。真性菌尿的标准：①新鲜中段尿沉渣革兰氏染色油镜观察，细菌＞1个/视野；②新鲜中段尿细菌培养计数≥105/ml；③膀胱穿刺尿培养阳性。掌握“急性肾孟肾炎、尿路结石及慢性肾衰竭”知识点。